我国允许使用的合成色素共有几种
A. 7种
B. 8种
C. 9种
D. 10种
E. 20余种

正确答案：E。20余种